男性，76岁。有阻塞性肺气肿史，咳嗽，咳脓痰，伴气急，加重2周，今晨起神志恍惚。体检：嗜睡，口唇青紫，两肺湿啰音。心率116次/分，律齐，血压180/100mmHg，神经系统检查未见异常。可能的诊断是
A. 脑血管意外
B. 呼吸衰竭
C. 急性左心衰竭
D. 右心衰竭
E. 高血压危象

正确答案：B。呼吸衰竭